磨牙后腺中可见的恶性肿瘤是
A. 沃辛瘤
B. 多形性腺瘤
C. 腺样囊性癌
D. 腺泡细胞癌
E. 黏液表皮样癌

正确答案：E。黏液表皮样癌

解析：黏液表皮样癌发生与腮腺者居多，其次是腭部和下颌下腺，也可发生于其他小唾液腺，特别是磨牙后腺。掌握“腺样囊性癌”知识点。